德国一位女牙医助理马里翁在一次车祸中受重伤，送到医院后被判定为脑死亡，后来的全面检查表明：当时该“患者”腹中4个月的胎儿完全正常，如果“患者”凭借现代医术使植物人状态长期维持下去，就可以保证胎儿发育成熟，直至出生；如果让“患者”体面地死去，就必须撒掉生命维持系统。这个难题，要求医学服务认真解决
A. 医学中能不能做与伦理上应不应做的矛盾
B. 临床诊断技术的问题
C. 临床治疗技术的问题
D. 服务态度的问题
E. 医药卫生资源宏观分配的矛盾

正确答案：A。医学中能不能做与伦理上应不应做的矛盾